关于药品标准，正确的是
A. 药品标准是国家药品标准
B. 药典是药品质量规范标准
C. 《太平惠局方》是我国及全世界第一部全国药典
D. 我国现行药品标准是药典和部颁标准
E. 部颁标准是药品标准生产、检验、供应、使用、监管的依据。

正确答案：A、B、D。药品标准是国家药品标准；药典是药品质量规范标准；我国现行药品标准是药典和部颁标准

解析：本题考查的是中药质量标准。关于药品标准，正确的是药品标准是国家药品标准（A对）、药典是药品质量规范标准（B对）与我国现行药品标准是药典和部颁标准（D对）。国务院药品监督管理部门颁布的《中国药典》和药品标准为国家药品标准。《中国药典》收载的品种须经过严格的医药学专家委员会进行遴选。主要收载我国临床常用、疗效肯定、质量稳定（工艺成熟）、质控标准较完善的品种。其他不能满足上述条件（包括上市时间较短）或有特殊情况的品种均收载于局颁或部颁标准。《中国药典》（一部）收载了药材和饮片、植物油脂和提取物、成方制剂和单味制剂的标准。《新修本草》是我国及全世界第一部全国药典（C错）。《新修本草》：又称《唐本草》，为隋唐时期唐代的本草代表作。本书是我国历史上第一部官修药典性本草，并被今人誉为世界上第一部药典。部/局颁标准：部／局颁标准是原卫生部或国务院药品监督管理部门组织国家药典委员会对不同企业的药品注册标准进行统一规范后的药品标准（E错）。